女，50岁。头部棍击伤，无昏迷史及意识障碍，无颅骨骨折，1个月后出现颅内高压症状，最可能的诊断是
A. 慢性硬膜外血肿
B. 多发颅内血肿
C. 慢性硬膜下血肿
D. 急性颅内血肿
E. 脑震荡后遗症

正确答案：C。慢性硬膜下血肿

解析：中年女性患者，头部外伤史1月，当时无阳性体征及症状。现出现颅内高压症状，最可能的诊断是慢性硬膜下血肿（C对）。慢性硬膜外血肿（A错）较少见，多表现为进行性头痛、恶心、呕吐，绝大多数患者有颅骨骨折。多发颅内血肿（B错）的病情重、进展快，大多数患者会出现伤后严重的意识障碍。急性颅内血肿（D错）指伤后3天内出现症状的颅内血肿，该患者伤后1个月才出现症状，故排除。脑震荡后遗症（E错）常表现为头痛、疲乏、失眠、多梦、注意力不集中、健忘等，一般不出现颅内高压症状。